不符合化学药品说明书中关于【用法用量】要求的是
A. 应标有常用剂量
B. 应标有明确的用药方法
C. 需按疗程用药的应标明疗程
D. 应标有动物的半数致死量
E. 可以标有负荷剂量和维持剂量

正确答案：D。应标有动物的半数致死量

解析：本题考查用法用量。不符合化学药品说明书中关于【用法用量】要求的是应标有动物的半数致死量（D错，为本题正确答案）。化学药品和治疗用生物制品应当包括用法和用量两部分。需按疗程用药或者规定用药期限的，必须注明疗程（C对）、期限；详细列出该药品的用药方法（B对），准确列出用药的剂量（AE对）、计量方法、用药次数以及疗程期限，并应当特别注意与规格的关系。用法上有特殊要求的，应当按实际情况详细说明。